对育龄人群有生殖毒性的高警示药品是
A. 肾上腺素
B. 胰岛素
C. 降钙素
D. 高锰酸钾
E. 阿维A酸

正确答案：E。阿维A酸

解析：本题考查阿维A酸。对育龄人群有生殖毒性的高警示药品是阿维A酸（E对）胶囊。肾上腺素（A错）、胰岛素(B错）、高锰酸钾（D错）是高警示药品，但不是对育龄人群有生殖毒性的高警示药品。降钙素（C错）不属于高警示药品。